慢性甲基汞中毒
A. 经食物链传递而富集最终影响人体健康的是
B. 胚胎期和婴儿发育早期机体严重碘缺乏可引起
C. 污水灌溉农田使农作物受污染而危害人体健康的是
D. 引起居民以斑釉齿和骨骼损害为特征的疾病是
E. 以皮肤损害为显著特点的生物地球化学性疾病为

正确答案：A。经食物链传递而富集最终影响人体健康的是

解析：本题考查慢性甲基汞中毒。经食物链传递而富集最终影响人体健康的是（A对BCDE错）慢性甲基汞中毒。慢性甲基汞中毒是人群长期暴露于被汞（甲基汞）污染的环境，主要是水体汞（甲基汞）污染和由此导致的鱼贝类等食物甲基汞污染，造成摄入者体内甲基汞蓄积并超过一定阈值所引起的以中枢神经系统损伤为主要中毒表现的环境污染性疾病。